下列关于咬肌间隙的叙述中，不恰当的是
A. 又称咬肌下间隙
B. 位于下颌支与翼内肌之间
C. 前邻磨牙后区，后界腮腺
D. 间隙感染多来自下颌第三磨牙
E. 与翼颌、颊、颞及颞下诸间隙相连通

正确答案：B。位于下颌支与翼内肌之间

解析：咬肌间隙又称咬肌下间隙，位于咬肌与下颌支之间。前邻磨牙后区，后界腮腺。间隙感染多来自下颌第三磨牙。咬肌间隙与翼颌、颊、颞及颞下诸间隙相连通。掌握“面侧深区及颌面部各间隙的境界”知识点。